男童，7岁。右侧鼻腔反复出血2个月，量少，无其他不适。平时不爱喝水，喜挖鼻。既往体健，无家族遗传病史。该患者鼻出血时的最佳应急处理措施是
A. 输血
B. 口服止血药
C. 静脉输止血药
D. 拇指按压鼻翼止血
E. 鼻腔填塞法止血

正确答案：D。拇指按压鼻翼止血

解析：本题考查止血方法。患儿右侧鼻腔反复出血2个月，平时不爱喝水（干燥），喜挖鼻（鼻腔内血管破裂）。量少，无其他不适，既往体健，无家族遗传病史（排除其他疾病引发）。该患者鼻出血时的最佳应急处理措施是拇指按压鼻翼止血（D对）。使用外力压迫局部，可使微小血管管腔闭塞，从而达到止血效果。输血（A错）主要是用于急性失血而引起的低血容量性休克，以及慢性失血而导致的一系列的症状。口服止血药（B错）：当身体出现出血的症状,尤其是内脏出血时可以适当口服止血药进行止血。静脉输止血药（C错）可用于治疗消化道出血（如呕血、便血）、支气管和肺部出血（如咯血），还可用于产科止血、催产及产后收缩子宫等；治疗临床科室的出血及出血性疾病，还可用于预防出血；治疗急性和慢性、全身性和局限性原发性纤维蛋白溶解亢进所引起的各种出血。鼻腔填塞法止血（E错）用于多种原因引起的鼻出血，出血较多，渗血面大。一般方法止血无效时，常采用此法，以达到压迫止血目的。